患者，男，72岁，既往有高血压、心绞痛、心力衰竭、房室传导阻滞和胃溃疡病史。一个月前，因出现哮喘症状就诊，医师处方布地奈德气雾剂200㎍bid吸入，沙丁胺醇气雾剂100㎍prn吸入，氨氯地平片5mgqd口服及硝酸甘油片0.5mgprn舌下含服治疗。该患者因近日在浇花时出现心悸和手指轻微震颤而就诊。体格检查：T₃6.8℃，P120次/min，R28次/min，BP175/90mmHg。出现上述症状的可能原因是
A. 布地奈德剂量太大
B. 沙丁胺醇的不良反应
C. 氨氯地平的不良反应
D. 硝酸甘油剂量不足
E. 布地奈德的不良反应

正确答案：B。沙丁胺醇的不良反应

解析：本题考查药物的不良反应。出现上述症状的可能原因是沙丁胺醇的不良反应（B对）。沙丁胺醇为β₂受体激动剂，可能导致窦性心动过速，有诱发易感人群出现心律失常的潜在可能。部分使用高剂量β₂受体激动剂的老年患者，不论给药途径如何，可引发躯体震颤。布地奈德混悬液（AE错）为糖皮质激素类药物，可引起的不良反应有口腔念珠菌病、声音嘶哑、皮肤瘀斑及肺炎的发病率升高等。氨氯地平的不良反应（C错）有踝部水肿、头痛、面部潮红。硝酸甘油的不良反应（D错）有面色潮红、心率反射性加快和低血压及头痛等。